下列何肌不受臀上或臀下神经支配
A. 臀大肌
B. 臀中肌
C. 臀小肌
D. 梨状肌
E. 无

正确答案：D。梨状肌

解析：臀大肌（A对）由臀下神经支配。臀中肌（B对）和臀小肌（C对）由臀上神经支配。梨状肌（D错，为本题正确选项）受骶丛分支支配。